男，36岁，5天前发热咽疼，应用抗生素治疗无效。颈部浅表淋巴结肿大，咽部充血，扁桃体Ⅱ°肿大，下肢少许瘀斑。白细胞16.6×10⁹/L，原始细胞0.60，血红蛋白80g/L，血小板34×10⁹/L。体检中应特别注意的体征是
A. 睑结膜苍白
B. 胸骨压痛
C. 浅表淋巴结肿大
D. 皮肤出血点
E. 心脏杂音

正确答案：B。胸骨压痛

解析：患者考虑诊断为急性白血病。白血病增殖浸润的体征常有淋巴结、肝脾肿大，胸骨下段局部压痛，牙龈增生、肿胀，皮肤蓝灰色斑丘疹，绿色瘤等，其中胸骨压痛（B对）较浅表淋巴结肿大（C错）更有意义，体检时应特别注意；浅表淋巴结肿大还可见于淋巴瘤、炎症性疾病等，不具有特异性；睑结膜苍白（A错）、心脏杂音（E错）为贫血的一般体征，皮肤出血点（D错）为血小板减少的体征，均不具有特异性。